尿道球部损伤最常见的病因是
A. 尿道镜检查
B. 会阴部刺伤
C. 会阴部骑跨伤
D. 尿道扩张
E. 骨盆骨折

正确答案：C。会阴部骑跨伤

解析：尿道球部损伤多见于会阴部骑跨伤（C对）；骨盆骨折（E错）多引起后尿道膜部尿道撕裂，甚至前列腺尖处撕断。